不孕症肝气郁结证，应首选的方剂是
A. 调肝汤
B. 柴胡疏肝散
C. 逍遥散
D. 开郁种玉汤
E. 定经汤

正确答案：D。开郁种玉汤

解析：不孕证肝气郁结证首选开郁种玉汤，开郁种玉汤来源《傅青主女科》，由逍遥散化裁而成，功用：疏肝解郁，调经种子，主治妇人肝气郁结所致的不孕症。（D对）。调肝汤妇人肾水不足，肝气不舒。行经后少腹疼痛（A错）。柴胡疏肝散具有疏肝理气，活血止痛之功效，主治肝气郁滞证（B错）。逍遥散具有调和肝脾，疏肝解郁，养血健脾之功效，主治肝郁血虚脾弱证（C错）。定经汤肝肾气郁，经来断续，或前或后，行而不畅，有块，色正常，少腹胀痛，或乳房胀痛连及两胁（E错）。